下列不属于青少年健康危害行为的是
A. 尝试吸烟
B. 网络成瘾
C. 意外妊娠
D. 缺乏户外活动
E. 合理安排作息时间

正确答案：E。合理安排作息时间